肾锥体位于
A. 肾上端
B. 肾下端
C. 肾皮质
D. 肾髓质
E. 肾大盏

正确答案：D。肾髓质

解析：肾锥体位于肾髓质（D对），底朝皮质、尖向肾窦。